以下杂质检查项目所使用的试剂是，易炭化物
A. 25%氯化钡溶液
B. 硝酸银试液
C. 硫酸
D. 硝酸
E. 碘化钾试液

正确答案：C。硫酸